患者男，66岁，患高血压10年，吸烟史30年，一天前出现胸骨后压榨性疼痛，休息后缓解。心电图显示：ST段压低，心肌缺血。BP为160/89mmHg，心率为92次/分，患者即将接受的下列治疗方案中，用法用量错误的是
A. 硝酸异山梨酯片10mg tid
B. 阿司匹林肠溶片100mg qd
C. 美托洛尔缓释片47.5mg qd
D. 地尔硫䓬片20mg qd
E. 雷米普利片10mg qd

正确答案：D。地尔硫䓬片20mg qd

解析：本题考查地尔硫䓬片的用法用量。根据题干，患者即将接受的治疗方案用法用量错误的是：地尔硫䓬片20mg qd（D错，为本题正确答案）。地尔硫䓬：普通片30～60mg，tid，缓释片90mg，qd。硝酸异山梨酯片10mg，tid（A对）、阿司匹林肠溶片100mg，qd（B对）、美托洛尔缓释片47.5mg，qd（C对）和雷米普利片10mg，qd（E对）的用法用量均正确，可作为该患者的治疗方案。